男，50岁，右下567缺失，左下6缺失，右下8前倾，与对颌牙接触不良，余牙正常，设计牙支持式义齿时，右下8上卡环应如何设计
A. 三臂卡环
B. 三臂卡环并扩大支托，恢复其咬合
C. 圈形卡环
D. 圈形卡环，并扩大支托，恢复其咬合
E. 倒钩卡环，并扩大支托，恢复其咬合

正确答案：D。圈形卡环，并扩大支托，恢复其咬合

解析：本题考查卡环的种类及适应证。圈形卡环，多用于最后孤立的磨牙上，基牙向近中舌侧（多为下颌）或近中颊侧（多为上颌）倾斜者。且该患者右下8前倾，与对颌牙接触不良，故右下8上卡环应设计为圈形卡环，并扩大支托，恢复其咬合（D对）。单纯的使用圈形卡环（C错）不能解决咬合问题。对于最后孤立的磨牙来说，三臂卡环（AB错）、倒钩卡环（E错）的固位及稳定作用不如圈形卡环，临床常使用圈形卡环。